直肠黏膜较厚，有3个横的半月形的皱襞，内有环肌纤维称为
A. 直肠壶腹
B. 直肠膀胱陷凹
C. 直肠子宫陷凹
D. 直肠瓣
E. 直肠柱

正确答案：D。直肠瓣

解析：直肠瓣是直肠壶腹内呈半月形的黏膜横皱襞，每个直肠瓣宽约1.4cm，长3cm，约相当于直肠圆周的2/3。一般有3个，最上方相当于直肠和乙状结肠交界处，位于左侧壁，距肛缘约12cm；中瓣位于右侧壁，距肛缘约9cm，与腹膜反折平面相对，确定直肠肿瘤与腹腔关系时常以此瓣为标志；下瓣位于左侧壁，距肛缘约7cm，当直肠充盈时，该瓣常可消失，而排空时则较显著。直肠瓣有阻止粪便排出的作用（D对）。